抑郁症首选
A. 碳酸锂
B. 丙米嗪
C. 氯丙嗪
D. 奋乃静
E. 五氟利多

正确答案：B。丙米嗪